治疗胆绞痛宜选用下列哪种搭配
A. 哌替啶+阿托品
B. 氯丙嗪+阿托品
C. 哌替啶+氯丙嗪
D. 去痛片+阿托品
E. 哌替啶+喷他佐辛

正确答案：A。哌替啶+阿托品